下列哪部著作是我国第一部论述病源与病候诊断的专著
A. 《肘后备急方》
B. 《千金要方》
C. 《伤寒杂病论》
D. 《诸病源候论》
E. 《诊家正眼》

正确答案：D。《诸病源候论》

解析：隋代巢元方等编撰的《诸病源候论》，是我国第一部论述病源与病候诊断的专著（D对）。葛洪《肘后备急方》中对天行发斑疮（天花）、麻风等传染病的发病特点和临床症状进行描述和诊断（A错）。《千金要方》是综合性临床医著，被誉为中国最早的临床百科全书（B错）。《伤寒杂病论》将理药有机结合，用以阐释病、脉、证、治，以六经为纲辨伤寒，以脏腑为纲辨杂病，建立了辨证论治的体系（C错）。明末李中梓的《诊家正眼》是脉诊的专著，使脉学得到不断的充实和完善（E错）。